对有深窝沟的适龄儿童开展窝沟封闭预防龋齿属于以下哪种口腔健康促进的途径
A. 全民途径
B. 共同危险因素控制途径
C. 高危人群途径
D. 决策者途径
E. 制定危险因素预防途径

正确答案：C。高危人群途径

解析：高危人群途径：人群中每个个体发生龋病的危险性是不同的，龋病的高危人群对整个人群的口腔健康影响较大，因此，在开展口腔健康促进活动时，选择针对龋病高危人群的预防措施和方法，预防和控制高危人群的龋病，从而提高整个人群的口腔健康状况。例如对有深窝沟的适龄儿童开展窝沟封闭预防龋齿。掌握“口腔健康促进”知识点。